正确的是
A. 全部由扁骨组成
B. 各骨间都由缝相连
C. 主要的囟都与顶骨有关
D. 下颌骨是颅骨中惟一可以活动的骨
E. 上述均不对

正确答案：C。主要的囟都与顶骨有关

解析：颅骨除下颌骨和舌骨外（B错），彼此借缝或软骨牢固连结形成颅,保护并支持脑和感觉器（D错）。前囟位于矢状缝与冠状缝相接处，后囟位于矢状缝与人字缝会合处，都和顶骨有关（C对）。